崩漏的主要病机是
A. 阴虚欠旺，经血失约
B. 气虚不摄，经血失约
C. 瘀血内阻，血不归经
D. 冲任损伤，经血失约
E. 阳盛血热，迫血妄行

正确答案：D。冲任损伤，经血失约

解析：素体脾虚，统摄无权或肾气亏虚，封藏失司，或素体阳盛血热或阴虚内热，热伤冲任，迫血妄行或瘀血阻络，血不归经而妄行致冲任损伤，不能制约经血，经血失约，使子宫藏泻失常而致崩漏（D对）。阴血亏虚，内生虚热，虚火动血，发致崩漏，阴虚欠旺，经血失约为崩漏的其中一个发病机理，非主要病机（A错）。脾气亏虚，脾统血失司，不能制约经血，发为崩漏，气虚不摄，经血失约为崩漏的其中一个病机，非主要病机（B错）。热灼、寒凝、虚滞致瘀，内生瘀血，瘀阻冲任、子宫，血不归经而妄行发为崩漏，瘀血内阻，血不归经为崩漏的一个形成机理，非主要机理（C错）。素体阳盛血热，热伤冲任，迫血妄行，发为崩漏，阳盛血热，迫血妄行为其中一个发病机理，非主要病机（E错）。